在6～12个月内，曾用激素治疗过两周的病人，施行手术应
A. 术前1周给激素
B. 术中开始用激素
C. 术后立即用激素
D. 术前2天开始用激素
E. 不必用激素

正确答案：D。术前2天开始用激素

解析：凡是正在应用激素治疗或在6～12个月内曾用激素治疗，并且使用时间超过1～2周的患者，可在术前2天开始用激素（D对）如氢化可的松，每日100mg，手术当天300mg。术前1周给激素（A错）则激素使用的时间过长，易引起术后多种并发症。术中开始用激素（B错）和术后立即用激素（C错）则激素的抗炎作用起效较慢，无法达到预期效果。不用激素（E错）则患者术后可能会出现超敏反应等表现，不利于患者术后恢复。